最易导致脘腹胀满，嗳腐吞酸，厌食等症的是
A. 摄食不足
B. 饮食不洁
C. 暴饮暴食
D. 饮食偏寒
E. 饮食五味偏嗜

正确答案：C。暴饮暴食

解析：暴饮暴食，或中气虚弱而强食，以致脾胃难于消化转输而引起疾病。轻者表现为饮食积滞不化，可见脘腹胀满疼痛，嗳腐吞酸，呕吐泄泻，厌食纳呆等（C对）。长期摄食不足，营养缺乏，气血生化减少，一方面因气血亏虚而脏腑组织失养，功能活动衰退，全身虚弱；另一方面又因正气不足，抗病力弱，招致外邪入侵，从而继发其他疾病。此外，长期摄食过少，胃腑失于水谷充养，也可损伤胃气，而致胃部不适或胃脘疼痛等；如果有意过度抑制食欲，又可发展成厌食等较为顽固的心身疾病。儿童时期，如果饮食过少可致营养不良，则影响正常的生长发育（A错）。饮食不洁而致病变以胃肠病为主。如进食腐败变质食物，则胃肠功能紊乱，出现脘腹疼痛，恶心呕吐，肠鸣腹泻等；若进食被寄生虫污染的食物，则可导致各种寄生虫病，如蛔虫病、绕虫病等，常表现有腹痛时作，嗜食异物，面黄肌瘦等；若进食被疫毒污染的食物，可发生某些传染性疾病，如痢疾等。如果进食或误食被毒物污染或有毒性的食物，则会发生食物中毒，轻则脘腹疼痛，呕吐腹泻，重则毒气攻心，神志昏迷，甚至危及生命（B错）。偏食生冷寒凉之品，久则易于耗伤脾胃阳气，导致寒湿内生（D错）。如果长期偏嗜某种性味的食物，就会导致相应所入之脏气偏盛，功能活动失调而引发疾病（E错）。